对口腔黏膜有麻醉作用，产生麻木感，需整片吞服，不可嚼碎的镇咳药是
A. 右美沙芬
B. 喷托维林
C. 苯丙哌林
D. 可待因
E. 羧甲司坦

正确答案：C。苯丙哌林

解析：本题考查药物的使用。对口腔黏膜有麻醉作用，产生麻木感，需整片吞服，不可嚼碎的镇咳药是苯丙哌林（C对）。苯丙哌林对口腔黏膜有麻醉作用，产生麻木感觉，服药时需整片吞服，不可嚼碎。右美沙芬（A错）可引起嗜睡，对驾车、高空作业或操作机器者宜慎用。喷托维林（B错）慎用于青光眼、心功能不全者；有报道喷托维林可造成儿童呼吸抑制，故5岁以下儿童不宜应用。可待因（D错）对过敏者、多痰者、婴幼儿禁用。羧甲司坦（E错）胃溃疡患者、孕妇慎用。